某工厂已在一周前对全厂职工做过健康检查，检查项目包括内科检查、肝功能、B超、血常规、心电图、胸部X线透视。在对该厂三硝基甲苯接触工人的健康检查时，还必须补充进行
A. 拍摄胸部X线片
B. 脑电图检查
C. 肾功能检查
D. 眼科检查
E. 肺功能检查

正确答案：D。眼科检查